慢性肺心病的表现以下错误的是
A. 右心室壁前壁肺动脉圆锥膨隆
B. 右心室壁肥厚增生
C. 心尖圆钝
D. 右心室腔扩张
E. 右心室乳头肌和肉柱萎缩

正确答案：E。右心室乳头肌和肉柱萎缩

解析：慢性肺源性心脏病，简称肺心病，是因慢性肺疾病、肺血管及胸廓的病变引起肺循环阻力增加，肺动脉压升高而导致以右心室壁肥厚、心腔扩大甚或发生右心衰竭的心脏病。其心脏病变，以右心的病变为主，心室壁肥厚（B对），心室腔扩张（D对），扩大的右心室占据心尖部，外观钝圆（C对）。心脏重量增加，可达850g。右心室前壁肺动脉圆锥显著膨隆（A对），右心室内乳头肌和肉柱显著增粗，室上嵴增厚（E错，为本题正确答案）。